郭某，男性，54岁。症见心悸不安，胸闷不舒，心痛时作，唇甲青紫，舌紫暗，脉涩，治疗应选用
A. 桃仁红花煎
B. 硃砂安神丸
C. 丹参饮
D. 归脾汤
E. 天王补心丹

正确答案：A。桃仁红花煎

解析：心主血脉，心脉瘀阻，心失所养，故见心悸不安；血瘀气滞，心阳被遏，故见胸闷不舒；心络挛急则心痛时作，脉络瘀阻则见唇甲青紫；舌紫暗，脉涩，均为心悸心脉瘀阻证的特点，治法为活血化瘀，理气通络，方药选用桃仁红花煎加减（A对）。朱砂安神丸（B错）可以清心泻火，宁心安神，用于治疗心火炽盛证。丹参饮（C错）可以活血化瘀，行气止痛，用于治疗血瘀气滞，心胃诸痛。归脾汤（D错）可以补益心脾，养血安神，用于治疗心脾气血两虚证。天王补心丹（E错）可以滋阴清火，养心安神，用于治疗阴虚火旺证。